女，28岁，妊娠38周，B超示胎儿脐带绕颈2周，拟行剖宫产术。4年前曾因外伤住院，接受输血后出现严重过敏反应。孕妇一般状况良好，心、肝、肾功能正常，血Hb100g/L。术前拟申请备血400ml。应选择的血液成分是
A. 洗涤红细胞
B. 悬浮红细胞
C. 浓缩血小板
D. 新鲜冰冻血浆
E. 冷沉淀

正确答案：A。洗涤红细胞

解析：成年女性患者，接受输血后出现严重过敏反应，应选择的血液成分是洗涤红细胞（A对）。悬浮红细胞（B错）适用于急慢性贫血。浓缩血小板（C错）适用于再生障碍性贫血和各种血小板低下的病人及大量输库存血或体外循环手术后血小板锐减的病人。新鲜冰冻血浆（D错）适用于各种凝血因子缺乏引起的出血和需要补充血容量或血浆蛋白的疾病。冷沉淀（E错）适用于缺乏Ⅷ因子及纤维蛋白原而出血不止的患者或血友病患者。